建议青春期男孩不穿紧身衣裤是为了
A. 保护皮肤
B. 促进生长
C. 防止频繁遗精
D. 保护生殖系统
E. 促进健康

正确答案：C。防止频繁遗精

解析：本题考查防止频繁遗精的主要措施。建议青春期男孩不穿紧身衣裤是为了防止频繁遗精（C对ABDE错）。防止频繁遗精的主要措施有：①开展生殖卫生教育，树立对遗精的正确认识；②合理安排学习生活，劳逸适度；③睡前不宜剧烈活动或阅读带有言情色彩的小说，避免过度兴奋；④不穿紧身衣裤，采取侧卧睡姿，以减少对外生殖器的刺激。